青霉素钠具有下列哪些特点
A. 在酸性介质中稳定
B. 遇碱使β-内酰胺环破裂
C. 溶于水不溶于有机溶剂
D. 具有α-氨基苄基侧链
E. 对革兰阳性菌、阴性菌均有效

正确答案：B、C。遇碱使β-内酰胺环破裂；溶于水不溶于有机溶剂

解析：本题考查青霉素钠的作用。青霉素钠为青霉素钠盐，易溶于水，难溶于有机溶剂（C对）。青霉素在酸性或碱性条件下，均可以使β-内酰胺环裂解（B对A错）。青霉素不具有α-氨基苄基（D错）。青霉素类药对革兰阳性、革兰阴性球菌及某些革兰阳性杆菌（E错）均有效，对革兰阴性杆菌不敏感。